等标污染负荷考虑了污染物的
A. 排放量
B. 慢性毒作用阈浓度
C. 排放标准
D. 排放量和慢性毒作用阈浓度
E. 排放量和排放标准

正确答案：E。排放量和排放标准

解析：本题考查等标污染负荷需要考虑的污染物内容。等标污染负荷是把i污染物的排放量稀释到其相应排放标准时所需的介质量，用以评价各污染源和各污染物的相对危害程度。它考虑了污染物的排放量和排放标准（E对ABCD错）。